35岁女性，既往无肝病，2个月前因手术输血800ml近日出现腹胀、乏力，ALT200U/L，化验甲肝抗体（-），HBsAg（-），抗HBc（-），抗HBs（+），抗HCV（+），诊断应考虑
A. 术后引起中毒性肝炎
B. 甲型肝炎
C. 乙型肝炎
D. 输血后肝炎
E. 急性丙型肝炎

正确答案：E。急性丙型肝炎

解析：根据实验室检验可知患者为丙肝病毒感染，丙肝病毒多由血液、血液制品传播，由于患者有输血史。可初步确诊输血所致急性丙型肝炎。掌握“病毒性肝炎”知识点。